表示暴露组发病率是对照组发病率的比
A. RR
B. AR
C. AR%
D. OR
E. PARP

正确答案：A。RR